下列关于尖牙保护（牙合）的描述中，正确的是
A. 以尖牙作支撑，对其他牙齿起到保护作用
B. 正中关系（牙合）与正中（牙合）协调
C. 侧方咬合运动时，工作侧只有尖牙保持接触非工作侧牙齿不接触
D. 在做前伸咬合运动时，上下颌前牙切缘相对接触，后牙不接触
E. 以上均正确

正确答案：E。以上均正确

解析：尖牙保护（牙合）：是以尖牙作支撑，对其他牙齿起到保护作用。正中关系（牙合）与正中（牙合）协调；侧方咬合运动时，工作侧只有尖牙保持接触非工作侧牙齿不接触；在做前伸咬合运动时，上下颌前牙切缘相对接触，后牙不接触。掌握“（牙合）分类及临床意义与面部结构”知识点。